抗甲状腺药甲巯咪唑所致不良反应
A. 粒细胞计数减少
B. 体位性低血压
C. 性功能降低
D. 淋巴结肿大
E. 视物模糊

正确答案：A。粒细胞计数减少

解析：本题考查甲巯咪唑的不良反应。粒细胞计数减少（A对）是抗甲状腺药甲巯咪唑的不良反应。体位性低血压（B错）又叫直立性低血压，是由于体位的改变而发生脑供血不足引起的低血压，并非甲巯咪唑的不良反应。性功能低下（C错）不是甲巯咪唑的不良反应。淋巴结肿大（D错）的原因主要是感染、肿瘤、反应性增生等，不是甲巯咪唑的不良反应。视物模糊（E错）不是甲巯咪唑的不良反应。